核质以外的遗传物质，可进行自我复制的是
A. 核质
B. 质粒
C. 核糖体
D. 肽聚糖
E. 胞质颗粒

正确答案：B。质粒

解析：质粒种类繁多，由闭合环状双链DNA构成，可自我复制，是核质以外的遗传物质，能携带多种遗传性状，并可通过结合、转化等方式，在细菌间传递质粒，而使细菌获得新的生物学性状。掌握“细菌的大小、形态和基本结构”知识点。